转移的最常见部位是肝的转移方式为
A. 直接蔓延
B. 医源转移
C. 血行转移
D. 腺行转移
E. 淋巴转移

正确答案：C。血行转移

解析：本题考查宫颈癌。血行转移多发生在晚期。肝是血行转移（C对）的最常见部位，也可侵犯肺、脑、骨骼、肾上腺、脾或胰腺等。